生物监测的特点不包括
A. 反映机体总的接触量
B. 反映机体总的负荷
C. 反映环境总的接触量
D. 具有系统性
E. 具有连续性

正确答案：C。反映环境总的接触量